以上哪项检查是可以确诊丙肝
A. HCVRNA
B. HCV抗体
C. HCV抗原
D. HBeAg
E. HBeAb

正确答案：A。HCVRNA

解析：HCVRNA阳性可诊断丙型肝炎（A对）。HCV抗体（B错）阳性提示已有HCV感染，可能不是现症感染。HBeAg（D错）和HBeAb（E错）是HBV感染的血清学标志物。